慢性龈炎的特点不包括
A. 重症者可累及附着龈
B. 龈袋可超过3mm
C. 有轻度的附着丧失
D. 龈红肿、松软
E. 碰触时易出血

正确答案：C。有轻度的附着丧失

解析：本题考查慢性龈炎的临床表现。慢性龈炎的特点不包括有轻度的附着丧失（C错，为本题的正确答案）。慢性龈炎是菌斑性牙龈病中最常见的疾病，牙龈的炎症主要位于游离龈和龈乳头，重症者可累及附着龈（A对），患者在刷牙或咬硬物等碰触时易出血（E对），由于结缔组织水肿和胶原的破坏，牙龈变得红肿、松软（D对），缺乏弹性。同时，由于组织的水肿或增生，龈沟的探诊深度可达3mm以上（B对），此时结合上皮虽可有向根方或侧方的增殖，但尚无附着丧失，也无牙槽骨吸收，形成的是假性牙周袋。